有关一次最大浓度的采样，错误的是
A. 在污染最严重时采样
B. 在污染源的下风侧采样
C. 当风向改变时停止采样
D. 采样时间最短也要30分钟
E. 在气象条件最不利于污染物扩散时采样

正确答案：D。采样时间最短也要30分钟

解析：本题考查一次最大浓度的采样。一次最大浓度应在污染最严重时采样（A对），即在生产负荷最大，气象条件最不利于污染物扩散时（E对），在污染源的下风侧采样（B对）。当风向改变时应停止采样（C对），采样时间一般为10～20分钟（D错，为本题正确答案）。